阴部干涩，灼热瘙痒，五心烦热，舌红苔少，脉细数其中医证型是
A. 肝肾阴虚型
B. 脾肾阳虚型
C. 湿热下注型
D. 湿虫滋生型
E. 津亏血少型

正确答案：A。肝肾阴虚型

解析：因为肝脉过阴器，肾司二阴，肝肾阴虚，则会出现阴部干涩，灼热瘙痒的症状；阴虚内热，故五心烦热；舌红少苔，脉细数均为肝肾阴虚之征，故可判断为肝肾阴虚型（A对）。湿热下注证证候∶带下量多，色黄或呈脓性，质黏稠，有臭气，或带下色白质黏，呈豆渣样，外阴瘙痒，小腹作痛，口苦口腻，胸闷纳呆，小便短赤。舌红苔黄腻，脉滑数（C错）。湿虫滋生证证候∶阴部瘙痒，如虫行状，甚则奇痒难忍，灼热疼痛，带下量多，色黄呈泡沫状，或色白如豆渣状，臭秽，心烦少寐，胸闷呃逆，口苦咽干，小便黄赤。舌红苔黄腻，脉滑数（D错）。脾肾阳虚证证候∶带下量多，绵绵不断，质清稀如水，腰酸如折，畏寒肢冷，小腹冷感，面色晦暗，小便清长，或夜尿多，大便潇薄。舌质淡苔白润，脉沉迟（B错）。